氯己定能较好地抑制龈上菌斑形成和控制龈炎，平均效果可达到
A. 0.4
B. 0.5
C. 0.6
D. 0.7
E. 0.8

正确答案：C。0.6

解析：氯己定能较好地抑制龈上菌斑形成和控制龈炎，平均效果达到60%。掌握“菌斑控制及提高宿主抵抗力”知识点。